女，15岁。发现贫血黄疸5年。脾肋下2.5cm，质中。血红蛋白90g/L，网织红细胞比例0.05，白细胞和血小板均正常。红细胞渗透压渗透脆性试验：0.7%盐水溶液开始溶血。其父也有轻度黄疸。考虑治疗措施时应首选
A. 输血
B. 糖皮质激素
C. 脾切除
D. 叶酸
E. 维生素B₁₂

正确答案：C。脾切除

解析：患者诊断为遗传性球形细胞增多症，脾切除（P554）（C对）对遗传性球形细胞增多症有显著疗效，故应为首选的治疗措施。输血（A错）仅适用于严重贫血患者；糖皮质激素（P558）（B错）主要用于治疗自身免疫性溶血性贫血；贫血严重时，可加用叶酸（D错），以防叶酸缺乏加重贫血或诱发危象；叶酸（D错）、维生素B₁₂（E错）主要用于治疗巨幼细胞贫血。